某人常乘飞机来往于国内外各大城市。由于目睹一次空难惨状，因而对乘飞机产生恐惧心理，乘机前严重焦虑，不敢登机。对这种情况，比较实用的心理治疗方法为
A. 精神分析疗法
B. 生物反馈疗法
C. 系统脱敏疗法
D. 理性情绪疗法
E. 询者中心疗法

正确答案：C。系统脱敏疗法